患儿，8个月，壮热呕吐，囟门高凸，其病机是
A. 肝风内动
B. 心火上炎
C. 热迫胃肠
D. 邪入气分
E. 邪入营血

正确答案：A。肝风内动

解析：囟门隆凸，按之紧张，为囟填，伴壮热呕吐，多为肝风内动，挟风火痰热上攻（A对）。心火上炎症见口舌生疮，口腔糜烂，心烦失眠，舌尖红绛等（B错）。热迫胃肠症见腹痛，暴注下泻，粪便黄臭，肛门灼热等（C错）。邪入气分可见壮热、口渴、汗出、脉洪等（D错）。邪入营血可见皮肤瘀点，谵语等（E错）。